环境污染急性危害的产生主要包括下列类型
A. 大气污染的烟雾事件
B. 事故性排放的环境污染事件
C. 核泄漏事故
D. 环境生物性污染引起的急性传染病
E. 以上均是

正确答案：E。以上均是